可导致尿潴留的药品
A. 氯苯那敏
B. 布美他尼
C. 氢氯噻嗪
D. 氨苯蝶啶
E. 磺胺嘧啶

正确答案：A。氯苯那敏

解析：本题考查药物的禁忌症。可导致尿潴留的药品是氯苯那敏（A对）。抗过敏药，如异丙嗪、苯海拉明、氯苯那敏等具有抗胆碱作用，抑制腺体分泌，表现为口干、舌燥、眼压升高，同时阻滞乙酰胆碱活性，使膀胱逼尿肌收缩力下降，对患有良性前列腺增生者可引起尿潴留。布美他尼（B错）为袢利尿剂，不良发应主要是可引起低氯血症、低钾血症、高尿酸血症和高血糖。氢氯噻嗪（C错）为噻嗪类利尿剂，可能引起血钾降低、血钠降低、血尿酸升高。氨苯蝶啶（D错）为留钾利尿剂，可引起高钾血症。服用磺胺嘧啶（E错）可出现结晶尿。